燥邪犯肺的咳嗽特征是
A. 咳声不扬，痰黄质稠
B. 咳声重浊紧闷
C. 干咳少痰无痰
D. 咳有痰声，痰多易咯
E. 咳声如犬吠，声音嘶哑

正确答案：C。干咳少痰无痰

解析：干咳无痰或痰少而黏，不易咯出，多属燥邪犯肺或阴虚肺燥所致（C对）。咳嗽声高响亮，痰黄质稠，多属热证，多因热邪犯肺，灼伤肺津所致（A错）。咳声重浊沉闷，多属实证，多因寒痰湿浊停聚于肺，肺失肃降所致（B错）。咳嗽痰多，易于咯出，多因痰浊阻肺所致（D错）。咳声如犬吠，伴有声音嘶哑，吸气困难，喉中有白膜生长，擦破流血，随之复生，是时行疫毒攻喉所致，多见于白喉（E错）。